大鼠长期致癌试验染毒期为
A. 1天
B. 14天
C. 90天
D. 12个月
E. 24个月

正确答案：E。24个月